为研究饮用水中微囊藻毒素与大肠癌发病的关系，有人对某地8个镇居民饮用水中微囊藻毒素浓度进行检测，以此作为环境暴露水平，同时收集近年来当地大肠癌发病率数据，以此作为疾病指标，然后对两种指标进行等级相关分析，这种研究方法属于
A. 出生队列分析
B. 生态学研究
C. 理论流行病学研究
D. 病例对照研究
E. 队列研究

正确答案：B。生态学研究